儿童膳食中哪种元素摄入过多与高血压的发生有关
A. 铁
B. 钙
C. 钠
D. 锡
E. 镁

正确答案：C。钠